下列各药中最容易引起水钠潴留的是
A. 氢化可的松
B. 地塞米松
C. 强的松
D. 醛固酮
E. 可的松醛固醇

正确答案：D。醛固酮

解析：本题考查醛固酮。下列各药中最容易引起水钠潴留的是醛固酮（D对）。醛固酮则是盐皮质激素的代表药，它对水盐代谢的作用强而对糖代谢的作用弱，易引起水钠潴留。氢化可的松（A错）、地塞米松（B错）、强的松（C错）、可的松均属于糖皮质激素类药物，其主要药理作用是抗炎、抗毒素、抗免疫和抗休克等，对水盐代谢的作用相对较小。